男性，39岁，既往曾有“蛋白尿”病史，一直未做系统治疗。近三周来出现恶心、呕吐，查体：血压190/120mmHg，轻度水肿，血肌酐360μmol/L，B超双肾缩小。不应出现下列哪项生化异常
A. 酸中毒
B. 低血钙
C. 低血钠
D. 低血镁
E. 高血钾

正确答案：D。低血镁

解析：慢性肾衰肾小球滤过率明显减少时镁的排出量减少，会产生轻度的高镁血症，而不是低镁血症。掌握“急性肾孟肾炎、尿路结石及慢性肾衰竭”知识点。